患者女，70岁，胸闷胸痛反复发作半年余，多于劳累有关。现胸闷气短，自汗，神倦畏寒，面色白，四肢不温，舌质淡胖，苔白，脉沉细心电图V₃、V₄、V₅、V₆导联ST段下移，T波倒置。治疗首选
A. 瓜蒌薤白半夏汤
B. 血府逐瘀汤
C. 参附汤合桂枝甘草汤
D. 知柏地黄丸
E. 柴胡疏肝散

正确答案：C。参附汤合桂枝甘草汤

解析：心绞痛发作时心电图示典型的缺血性改变，即以R波为主的导联中，出现ST段压低≥0.1mV，有时出现T波倒置，发作缓解后恢复。心肾阳虚，鼓动无力，故见胸闷；心阳虚衰，宗气衰少，胸阳不展，故见气短；阳虚卫外不固，固见自汗；阳虚形体失于温养，脏腑功能衰退，故见神倦畏寒，四肢不温；面部血脉不充，故见面色白；心肾阳虚，水湿泛滥，故见舌淡胖，苔白，脉沉细。治法：益气温阳，温经止痛。桂枝甘草汤具有补助心阳、生阳化气的功效；参附汤有益气回阳固脱的功效；两方合用可益气壮阳，温通心肾（C对）。瓜蒌薤白半夏汤通阳泄浊，豁痰宣痹，治疗痰浊内阻证（A错）。血府逐瘀汤活血化瘀，通脉止痛，治疗心血瘀阻证（B错）。知柏地黄丸滋阴清热，用于潮热盗汗，耳鸣遗精，口干咽燥（D错）。柴胡疏肝散疏肝理气，活血止痛，主治肝气郁滞证（E错）。